某初中学生，学习压力增加，一次体检时其血压值处于同性别同年龄组的P₉₇。若其确诊为高血压，则应养成低盐饮食习惯，其每日摄入食盐量不应超过
A. 2g
B. 2.5g
C. 3g
D. 5g
E. 6g

正确答案：B。2.5g